与远中（牙合）支托比较
A. 近中（牙合）支托减小了基牙所受的扭力，也减小了牙槽嵴的负担
B. 近中（牙合）支托减小了基牙所受的扭力，但增加了牙槽嵴的负担
C. 近中（牙合）支托增加了基牙所受的扭力，也增加了牙槽嵴的负担
D. 近中（牙合）支托增加了基牙所受的扭力，但减小了牙槽嵴的负担
E. 近中（牙合）支托既不能减小基牙所受的扭力，也不能减小牙槽嵴的负担

正确答案：B。近中（牙合）支托减小了基牙所受的扭力，但增加了牙槽嵴的负担

解析：本题考查近中（牙合）支托。近中（牙合）支托放在远中游离缺失邻缺隙侧基（牙合）面近中边缘嵴上，当受力向近中移动时，因为邻牙的支持，基牙所受扭力会减少或抵消；则更多的力会通过基托传导到牙槽嵴上（B对）。近中（牙合）支托指远中游离端义齿在邻缺隙基牙的（牙合）面近中边缘嵴放置的支托。支托的小连接体位于两邻牙的舌外展隙处，可与基牙形成小的导平面接触。远中游离端义齿的近缺隙基牙若采用远中（牙合）支托，当咬合力垂直作用于义齿时，基牙受力向远中倾斜，而采用近中（牙合）支托则基牙向近中倾斜，但由于近中有邻牙支持，使基牙受力减少或被抵消。由于近中（牙合）支托将支点从远中移至近中，位置前移，使基牙上的卡环臂与游离端位于支点同侧，（牙合）力作用下，卡环臂与基托同时下沉、卡环与基牙脱离接触、对基牙无扭力作用。同时，由于支点前移，加大了转动半径，因而使基托下组织的受力方向接近垂直，且较均匀。需要注意的是，支点前移会使游离距延长，在相同（牙合）力作用下，基牙受力减少，但基托下黏膜和牙槽骨组织受力增加。